经过冠状窦右端汇入冠状窦的是
A. 左冠状动脉
B. 右冠状动脉
C. 心大静脉
D. 心小静脉
E. 心最小静脉

正确答案：D。心小静脉

解析：心小静脉（D对）经过冠状窦右端汇入冠状窦，其接受锐缘及部分右室前、后壁的静脉血。